哪种流行病学研究中，研究人员控制着研究因素
A. 实验流行病学
B. 个案调查
C. 现况调查
D. 暴发调查
E. 病例对照调查

正确答案：A。实验流行病学

解析：本题考查实验流行病学的概念。在实验流行病学（A对BCDE错）研究中，研究人员根据预先设计的研究方案将研究对象分为对照组和病例组，人为的施加或减少处理因素，然后追踪观察处理因素的作用结果，比较和分析两组人群的结局，从而判断处理因素的效果。